处理肝外伤的措施中，相对不重要的是
A. 损伤处放置必要的引流管
B. 术中结扎局部断裂的血管和胆管
C. 早期全身应用维生素K
D. 去除失去活力的肝组织
E. 同时进行手术治疗和抗休克治疗

正确答案：C。早期全身应用维生素K

解析：探明肝破裂伤情后，应清除裂口内的血块、异物以及离断、粉碎或失去活力的肝组织（D对）。术中结扎局部断裂的血管和胆管（B对）。不论采用何种手术方式，肝外伤手术后，在创面和肝周应放置必要的引流管，防止渗出的血液和胆汁积聚导致继发感染（A对）。轻度肝实质裂伤，血流动力学指标稳定，或经补充血容量后保持稳定的伤员，可在严密观察下进行非手术治疗，生命体征经补充血容量后仍不稳定或需大量输血才能维持血压者，表明仍有活动性出血，应同时进行手术治疗和抗休克治疗（E对）。肝外伤为急症，若失血过多应早期输入凝血因子或血浆，早期全身应用维生素K（C错）意义不大。